导线卡环固位、稳定和支持作用均好的是
A. 一型观测线
B. 二型观测线
C. 三型观测线
D. 四型观测线
E. 以上均正确

正确答案：A。一型观测线

解析：一型观测线适用I型铸造或锻丝卡环，亦名I型导线卡环，该卡环固位、稳定和支持作用好。掌握“局部义齿类型，肯氏分类及模型观测”知识点。